位于肝胃韧带和胃前方的间隙为
A. 肝左下后间隙
B. 肝左上间隙
C. 肝右下间隙
D. 肝左下前间隙
E. 肝右上间隙

正确答案：D。肝左下前间隙

解析：位于肝胃韧带和胃前方的间隙为左前下间隙（D对）。肝左下后间隙（A错）的后方为大网膜，横结肠及其系膜。肝右下间隙（C错）的后方为肝肾隐窝。肝右上间隙（E错）后方为冠状韧带。